根尖周肉芽肿的上皮炎性增生，可导致哪种根尖周病变类型
A. 慢性根尖周肉芽肿
B. 急性牙槽脓肿
C. 急性牙周脓肿
D. 根尖周囊肿
E. 致密性骨炎

正确答案：D。根尖周囊肿

解析：本题考查急慢性根尖周炎。上皮性根尖肉芽肿，由于上皮炎性增生可导致炎性根尖周囊肿（D对）形成。